男，45岁，饱餐后出现上腹痛7小时，伴呕吐，疼痛持续性，向腰背部放射，蜷缩体位稍减轻，血清淀粉酶650U/dl。最具有诊断选择的检查是
A. 腹部超声
B. 腹部CT
C. 腹部核素扫描
D. 胃镜
E. 腹部X线

正确答案：B。腹部CT

解析：男，45岁，饱餐后出现上腹痛7小时（过度进食是急性胰腺炎的常见诱因），伴呕吐，疼痛持续性，向腰背部放射，蜷缩体位稍减轻（急性腹痛是急性胰腺炎患者常见首发症状），血清淀粉酶650U/dl（正常35~135U/L）。综上考虑诊断为急性胰腺炎。此时首选的检查应该是腹部CT（B对），是最具诊断价值的影像学检查。不仅能诊断急性胰腺炎，而且能鉴别是否合并胰腺组织坏死。腹部超声（A错）是急性胰腺炎的常规初筛影像检查，容易受到胃肠道积气干扰。腹部核素扫描（C错）、胃镜（D错）和腹部X线（E错）对胰腺炎的确诊作用不大。